初产妇，28岁。妊娠38周，主诉肋下有块状物。腹部检查：子宫呈纵椭圆形，胎先露部较软且不规则，胎心在脐上偏左。本例应诊断为
A. 枕先露
B. 面先露
C. 臀先露
D. 肩先露
E. 复合先露

正确答案：C。臀先露

解析：胎产式分为纵产式（头先露和臀先露）和横产式（肩先露）。该产妇子宫呈纵椭圆形，说明胎产式为纵产式（D错）；胎先露部较软且不规则，胎心在脐上偏左，提示臀先露（C对AB错）。复合先露能触及较硬的胎儿四肢，由于胎先露部较软且不规则，因此不考虑复合先露（E错）。